第—个萌出的恒牙为
A. 切牙
B. 尖牙
C. 第一前磨牙
D. 第二前磨牙
E. 第一磨牙

正确答案：E。第一磨牙

解析：恒牙中，第 1 磨牙首先长出，除第 3 磨牙外，其他各牙约在 14岁左右出齐 。第 3 磨牙萌出时间最晚，有的要迟至 28 岁或更晚，故又称智牙（E对）。